医师在执业活动中遵守法律规定和技术操作规范是
A. 医师的社会地位
B. 医师的执业条件
C. 医师的职责
D. 医师的权利
E. 医师的义务

正确答案：E。医师的义务

解析：医师在执业活动中遵守法律规定和技术操作规范是医师的义务。医师执业医师的义务《执业医师法》规定，医师在执业活动中应当履行遵守法律、法规，遵守技术操作规范的义务（E对）。